胫骨中下1/3骨折最常见的并发症是
A. 血管损伤
B. 神经损伤
C. 损伤性骨化
D. 骨筋膜室综合征
E. 骨折迟延愈合

正确答案：E。骨折迟延愈合

解析：胫骨的营养血管从胫骨干上、中1/3交界处进入骨内，中、下1/3的骨折使营养动脉损伤，使得供应下1/3段胫骨的血液循环显著减少；同时因下1/3段胫骨几乎无肌附着，由胫骨远端获得的血液循环很少，故下1/3段骨折愈合较慢，容易发生骨折延迟愈合（E对）。血管损伤（主要指大血管损伤）（A错）多见于胫骨上1/3骨折。神经损伤（B错）可见于腓骨颈骨折。损伤性骨化（C错）常见于关节扭伤、脱位或关节附近的骨折。骨筋膜室综合征（D错）多见于胫骨中1/3骨折。